氯磷定用于解救
A. 水银中毒
B. 有机磷中毒
C. 硫酸铜中毒
D. 氰化物中毒
E. 吗啡中毒

正确答案：B。有机磷中毒

解析：本题考查中毒解救。氯磷定用于解救有机磷中毒（B对）。有机磷农药中毒最主要的救治原则是清除毒物、特效解毒剂的应用、对症支持治疗,及早洗胃也可以减少毒物的吸收,早期合理应用特效解毒剂,包括阿托品、氯解磷定、碘解磷定等。水银中毒（A错）可用二巯丙磺钠、青霉胺和二巯丁二钠等解救。硫酸铜中毒（C错）可用依地酸钠等解救。氰化物中毒（D错）可用亚硝酸异戊酯、亚甲蓝等解救。吗啡中毒（E错）可用纳洛酮和烯丙吗啡等解救。